能疏肝理气的是
A. 枳实
B. 柿蒂
C. 沉香
D. 乌药
E. 香橼

正确答案：E。香橼

解析：本题考查的是香橼的功效。能疏肝理气的是香橼（E对）。香橼：【功效】疏肝理气，和中化痰。枳实（A错）：【功效】破气消积，化痰除痞。柿蒂（B错）：【功效】降气止呃。沉香（C错）：【功效】行气止痛，温中止呕，温肾纳气。乌药（D错）：【功效】行气止痛，温肾散寒。